患者男性，38岁，近1个月来右侧上下后牙区剧烈疼痛，每次发作数分钟至数小时，体检见右下第三磨牙近中斜位阻生，余牙无明显龋损。必须的辅助检查是
A. 全口牙位曲面体层X线片明确第三磨牙有无压迫下牙槽神经
B. 头颅CT或MRI明确颅内有无占位性病变
C. 三叉神经分支诊断性封闭
D. 面部软组织B超检查
E. 全口牙片检查牙槽骨情况

正确答案：B。头颅CT或MRI明确颅内有无占位性病变

解析：患者为年轻男性，疼痛性质类似于三叉神经痛，但不很典型，故应考虑继发性三叉神经痛的可能，需行头颅CT或MRI明确颅内有无占位性病变。故答案为B。掌握“三叉神经痛”知识点。